铸造金合金的铸造温度为
A. 1100℃以上
B. 850～1000℃
C. 500～1000℃
D. 850～300℃
E. 500～300℃

正确答案：A。1100℃以上

解析：本题考查铸造金合金的铸造温度。铸造金合金的铸造温度为1100℃以上（A对）。口腔用铸造金合金的含金量及铂族金属的量应不少于75%，如金-铂-钯合金、金-钯合金、金-钯-银合金等，它们的铸造温度均在1100℃以上。